患者，女，25岁。产后恶露过期不止，量较多，色红，质稠，大便干燥，舌红，脉滑数。其中医证型是
A. 血瘀型
B. 气虚型
C. 阴虚型
D. 血热型
E. 湿热型

正确答案：D。血热型

解析：患者产后恶露过期不止，量较多，色红，质稠，大便干燥，舌红，脉滑。是由于素体阴虚，复因产时伤血，阴液愈亏，虚热内生；或产后嗜食辛燥助阳之品；或情志不畅，肝郁化热；或感受热邪，热扰冲任，致迫血下行（D对CE错）。血瘀证证候：产后血性恶露过期不止，量时多时少，色紫暗，有血块，小腹疼痛拒按，块下痛减。舌紫暗，或边尖有瘀点瘀斑，脉弦涩（A错）。气虚证证候：产后恶露量多，或血性恶露过期不止，色淡红，质稀，无臭气，面色胱白，神疲懒言，四肢无力，小腹空坠。舌淡苔薄白，脉细弱或缓弱（B错）。